具有镇心安神，聪耳明目作用的药物是
A. 珍珠
B. 磁石
C. 牡蛎
D. 石决明
E. 蝉衣

正确答案：B。磁石

解析：磁石性味咸寒，归心肝肾经，具有镇惊安神，平肝潜阳，聪耳明目，纳气平喘的功效（B对）。珍珠的功效为安神定惊，明目消翳，解毒生肌，润肤祛斑（A错）。牡蛎的功效为潜阳补阴，重镇安神，软坚散结，收敛固涩，制酸止痛（C错）。石决明的功效为平肝潜阳，清肝明目（D错）。蝉蜕的功效为疏散风热，利咽开音，透疹，明目退翳，息风止痉（E错）。